不属于基因突变的遗传损伤为
A. 片段突变
B. 移码
C. 碱基转换
D. 裂隙和断裂
E. 碱基颠换

正确答案：D。裂隙和断裂